辛温发散，发汗不如麻黄、桂枝，长于理气安胎、解鱼蟹毒的药是
A. 防风
B. 薄荷
C. 紫苏
D. 荆芥
E. 西河柳

正确答案：C。紫苏

解析：本题考查的是紫苏的性能特点。辛温发散，发汗不如麻黄、桂枝，长于理气安胎、解鱼蟹毒的药是紫苏（C对）。紫苏：【性能特点】本品辛温行散。入肺经，散寒而发表；入脾经，理气而宽中、安胎，兼解鱼蟹毒。发汗不如麻黄、桂枝，长于理气、安胎、解毒。风寒感冒兼气滞，以及气滞胎动不安者用之最宜。亦作食品。防风（A错）：【性能特点】本品辛微温发散，甘缓不峻，生用、炒炭性能有别。生用辛散甘缓，微温力缓，入膀胱、脾经，散外风、胜湿邪而发表止痛；入肝经，祛内风而止痉。治风通用药，散外风、息内风皆宜，治风寒、风热及表证夹湿皆可，风寒湿三邪客体用之最宜。炒炭，涩多散少，敛兼升散，入脾、肝经而长于止血、止泻，治崩漏下血及泄泻宜用。薄荷（B错）：【性能特点】本品辛疏散，香辟秽，凉能清。入肺、肝经，既疏散风热而清利头目与咽喉、透疹，又疏肝解郁、辟秽。发汗力较强，尤善清利头目。治风热袭表或上攻者最宜，治肝郁化热可投。荆芥（D错）：【性能特点】本品生用辛微温发散，入肺、肝经。既善散肌表与血分风邪而解表、透疹、止痒、疗疮，又兼散息内风而止痉。力平和，散风发表通用，风寒、风热皆宜。炒炭微温涩敛，入肝经血分，收敛止血，治崩漏功良。西河柳（E错）：【性能特点】本品辛散甘解，平而偏温，开发升散，入肺、胃、心、肝经。既散风发表、透疹解毒，为治麻疹不透与风疹瘙痒所常用，麻疹初起、透发不畅用之最宜；又祛风除湿，治风湿痹痛可选，无论寒热均宜。